在直立姿势时，不能借助于重力引流的鼻旁窦是
A. 额窦
B. 蝶窦
C. 上颌窦
D. 筛窦前组
E. 筛窦后组

正确答案：C。上颌窦

解析：上颌窦开口较高，不能借助重力引流，要采取体位引流（C对）。